以下哪些描述与维生素C相符
A. 结构中含内酯，为L(+)-苏阿糖型
B. 水溶液pH值大约8.2
C. 可发生酮式-烯醇式互变
D. 水溶液易被空气氧化
E. 临床用于治疗坏血病，预防冠心病

正确答案：A、C、D、E。结构中含内酯，为L(+)-苏阿糖型；可发生酮式-烯醇式互变；水溶液易被空气氧化；临床用于治疗坏血病，预防冠心病